食管为肌性管道，上端与咽相续，下端与胃相连食管，可分为颈部、胸部和腹部3部，食管有3处生理性狭窄。食管的位置和分部的描述，正确的是
A. 在颈部位于气管的前面
B. 上端在第6颈椎体下缘处与咽相续
C. 分为颈段和胸段
D. 管壁肌层均为平滑肌
E. 下端在第12胸椎体处与胃幽门相续

正确答案：B。上端在第6颈椎体下缘处与咽相续

解析：食管在颈部位于气管后方(A错)，其上端在第6颈椎体下缘与咽相续(B对)，分为颈段、胸段和腹段(C错)，管壁肌层为骨骼肌和平滑肌(D错)，其下端在第11胸椎处与胃贲门相续(E错)。